患者腰痛以酸软为主，喜按喜揉，腿膝无力，遇劳更甚，卧则减轻。治疗应选用
A. 牛膝
B. 桃仁
C. 红花
D. 郁金
E. 鸡血藤

正确答案：A。牛膝

解析：腰痛以酸软为主，喜按喜揉，腿膝无力，遇劳更甚，卧则减轻，可诊断为肾虚，应当选用有补肝肾，强筋骨的牛膝（A对）。桃仁（B错）的功效是活血祛瘀，润肠通便，止咳平喘。红花（C错）的功效是活血通经，散瘀止痛。郁金（D错）的功效是活血止痛，行气解郁，清心凉血，利胆退黄。鸡血藤（E错）的功效是活血补血，调经止痛，舒经活络。